呈扁圆形团块状或片状；气味腥，味初甜而后有持久的麻辣感，粉末嗅之作嚏的药材是
A. 蟾酥
B. 麝香
C. 熊胆粉
D. 牛黄
E. 马宝

正确答案：A。蟾酥

解析：本题考查的是蟾酥药材的性状鉴别。呈扁圆形团块状或片状；气味腥，味初甜而后有持久的麻辣感，粉末嗅之作嚏的药材是蟾酥（A对）。蟾酥：【性状鉴别】药材呈扁圆形团块状或片状。棕褐色或红棕色。团块状者质坚，不易折断，断面棕褐色，角质状，微有光泽；片状者质脆，易碎，断面红棕色，半透明。气微腥，味初甜而后有持久的麻辣感，粉末嗅之作嚏。一些传统经验鉴别方法仍是鉴别动物类中药有效而重要的手段：手试法，如毛壳麝香手捏有弹性；麝香仁（B错）以水润湿，手搓能成团，轻揉即散，不应粘手、染手、顶指或结块。水试法，熊胆仁（C错）投于水杯中，即在水面旋转并呈现黄线下降而不扩散；牛黄（D错）水液可使指甲染黄，习称“挂甲”；火试法，如麝香仁撒于炽热坩埚中灼烧，初则迸裂，随即熔化膨胀起泡，浓香四溢，灰化后呈白色灰烬，无毛、肉焦臭，无火焰或火星；马宝（E错）粉末置于锡箔纸上加热，其粉末聚集，并发出马尿臭等。